引起疯牛病和人类克-雅病库鲁病等的病原因子是
A. 病毒
B. 类病毒
C. 拟病毒
D. 朊病毒（朊粒）
E. 衣原体

正确答案：D。朊病毒（朊粒）

解析：疯牛病（牛海绵状脑病）和人类克-雅病库鲁病均属于朊粒病（传染性海绵状脑病），是一种人和动物的慢性退行性、致死性中枢精神系统疾病，引起该病的病原因子是朊病毒（D对）。